呋喃苯胺酸
A. 有利尿作用
B. 有降压作用
C. 两者皆有
D. 两者皆无

正确答案：C。两者皆有

解析：本题考查呋喃苯胺酸。呋喃苯胺酸有利尿和降压作用（C对）。呋喃苯胺酸又名呋塞米，为强效利尿剂，通过特异性地与Cl⁻结合位点结合而抑制分布在髓袢升支管腔膜侧的Na⁺-K⁺-2C1⁻同向转运子，从而抑制NaCl的重吸收，降低肾的稀释与浓缩功能，排出大量接近于等渗的尿液。临床适用于：（1）急性肺水肿和脑水肿的救治。（2）该类利尿剂为急、慢性肾衰竭患者的首选治疗药。（3）用于高血压的治疗，是明显液体潴留心力衰竭的首选治疗药。对于高血压的治疗作用不如噻嗪类利尿剂，但对于肾小球滤过率降低和因钠潴留导致的高血压可以使用袢利尿剂。通常当肾小球滤过率（GFR）＜30ml/min时，应该用袢利尿剂替换噻嗪类利尿剂。呋塞米和托拉塞米特别适用于伴有肾功能受损的患者。（4）治疗肝硬化腹水以及加速某些毒物的排泄。